革兰染色后镜检衣原体的形态是
A. 始体
B. 原体
C. 内基小体
D. 革兰阳性圆形体
E. 革兰阴性圆形体

正确答案：E。革兰阴性圆形体

解析：衣原体是能通过细菌滤器，严格细胞内寄生，并有独特发育周期的原核细胞型微生物，革兰氏染色阴性。掌握“衣原体”知识点。